某医疗机构发现1例鼠疫患者，其病情特殊，传染性明显高于以往，医师怀疑发生菌株变异，计划将该菌株送往上级实验室进一步研究。关于该菌株的运输说法正确的是
A. 经省级卫生行政部门批准后方可运输
B. 在疾病预防控制机构指导下由医疗机构送往上级实验室
C. 由医疗机构和上级实验室共同委托第三方运输
D. 由医疗机构直接送往上级实验室
E. 由上级实验室自行来采取

正确答案：A。经省级卫生行政部门批准后方可运输

解析：鼠疫患者，其病情特殊，传染性明显高于以往，计划将该菌株送往上级实验室进一步研究，须经省级卫生行政部门批准后方可运输（A对）。